导致老年人合成维生素D能力下降的主要原因是
A. 户外活动减少
B. 食欲下降
C. 缺钙
D. 消化系统功能减退
E. 基础代谢率降低

正确答案：A。户外活动减少

解析：本题考查导致老年人合成维生素D能力下降的主要原因。老年人对维生素的利用率下降，户外活动减少（A对BCDE错）是导致老年人合成维生素D能力下降的主要原因。